心尖搏动位于左锁骨中线外第6肋间，考虑为
A. 左心室增大
B. 右心室增大
C. 左心房增大
D. 右心房增大
E. 心包积液

正确答案：A。左心室增大

解析：心尖搏动正常情况下位于第五肋间，左侧锁骨中线内0.5～1cm。心尖搏动位于左锁骨中线外第6肋间，较正常位置偏左偏下，考虑左心室肥大（A对）。右心室增大（B错）心尖搏动向左侧移位。左、右心房增大（CD错），心尖搏动移位不明显。心包积液（E错）时，心尖搏动减弱，无移位。